对脾的“志液体华窍”描述正确的是
A. 在志为悲
B. 在液为唾
C. 在体为肉
D. 其华在唇
E. 在窍为舌

正确答案：C、D。在体为肉；其华在唇

解析：本题考查的是脾与志、液、体、华、窍的关系。对脾的“志液体华窍”描述正确的是在体为肉（C对）与其华在唇（D对）。脾与志、液、体、华、窍的关系：1.脾在志为思；2.脾在液为涎；3.脾在体合肌肉，主四肢；4.脾在窍为口，其华在唇。在志为悲（A错）的是肺。肺与志、液、体、华、窍的关系：1.肺在志为忧（悲）；2.肺在液为涕；3.肺在体合皮，其华在毛；4.肺在窍为鼻，喉为肺之门户。在液为唾（B错）的是肾。肾与志、液、体、华、窍的关系：1.肾在志为恐；2.肾在液为唾；3.肾在体合骨，其华在发；4.肾在窍为耳及二阴。在窍为舌（E错）的是心。心与志、液、体、华、窍的关系：1.心在志为喜；2.心在液为汗；3.心在体合脉，其华在面；4.心在窍为舌。